肾病综合征最基本最重要病理生理机制是
A. 肾小管重吸收蛋白不足
B. 肝脏合成白蛋白不足
C. 血浆蛋白分解代谢增强
D. 大量蛋白尿
E. 蛋白质摄入不足

正确答案：D。大量蛋白尿

解析：肾病综合征最基本最重要病理生理机制是产生大量蛋白尿，在正常生理情况下，肾小球滤过膜具有分子屏障及电荷屏障作用，这些屏障作用受损致使原尿中蛋白含量增多，当其增多明显超过近曲小管回吸收量时，形成大量蛋白尿（ D对C错）。肾病综合征时大量白蛋白从尿中丢失，促进肝脏代偿性合成白蛋白增加（B错），同时由于近端肾小管摄取滤过蛋白增多，也使肾小管分解蛋白增加（A错）。此外，肾病综合征患者因胃肠道黏膜水肿导致食欲减退、蛋白质摄入不足、吸收不良或丢失，也是加重低蛋白血症的原因。蛋白质摄入不足是其中的原因但不是最基本最重要病理生理机制（E错）。